有调血脂作用，亦能增加动脉粥样硬化斑块稳定性或使斑块缩小的药物是
A. 洛伐他汀
B. 吉非贝齐
C. 考来烯胺
D. 烟酸
E. 普罗布考

正确答案：A。洛伐他汀

解析：本题考查洛伐他汀。有调血脂作用，亦能增加动脉粥样硬化斑块稳定性或使斑块缩小的药物是洛伐他汀（A对）。他汀类药物除了调血脂作用外，还有调节内皮功能、抗血小板黏附聚集、抗血栓形成、稳定粥样硬化斑块、抗氧化、抗炎、抑制心肌肥厚、促进骨形成和（或）抑制骨吸收等多方面作用。目前临床常用的他汀类药物包括：洛伐他汀、辛伐他汀、普伐他汀、氟伐他汀、阿托伐他汀、瑞舒伐他汀等。吉非贝齐（B错）为贝特类调血脂药。贝特类药物除了具有调脂作用外，还具有抗炎、降低纤维蛋白原及部分凝血因子水平、改善胰岛素敏感性、改善内皮细胞功能等作用，有益于动脉粥样硬化的防治。考来烯胺（C错）为胆汁酸结合树脂，主要用于治疗以TC和LDL-C升高为主，而且适用于TG水平正常不能使用他汀类的高胆固醇血症患者，如杂合子家族性Ⅱa型高脂血症。烟酸（D错）为烟酸类广谱降血脂药，除Ⅰ型以外的各型高脂血症均可用，但主要作为他汀类药物和饮食的辅助药物，用于血脂障碍，特别是低HDL-C和高TG患者，也可以用于他汀类药物禁用的患者。同时与胆汁酸结合树脂或苯氧酸类药物合用，提高疗效。普罗布考（E错）为抗氧化药，主要与其他调血脂药合用治疗高胆固醇血症。